属于酸性氨基酸的是
A. 丙氨酸
B. 赖氨酸
C. 丝氨酸
D. 谷氨酸
E. 苯丙氨酸

正确答案：D。谷氨酸

解析：酸性氨基酸包括谷氨酸（D对）、天冬氨酸（记忆技巧：三伏天“酸-谷-天”）。非极性脂肪族氨基酸包括脯氨酸、缬氨酸、异亮氨酸、亮氨酸、丙氨酸（A错）、甘氨酸（记忆技巧：谱写一两个丙肝患者）。碱性氨基酸包括赖氨酸（B错）、精氨酸、组氨酸（记忆技巧：拣来精读）。极性中性氨基酸包括谷氨酰胺、天冬酰胺、半胱氨酸、苏氨酸、丝氨酸（C错）（记忆技巧：古天乐半光身子，陪苏三）。芳香族氨基酸包括酪氨酸、苯丙氨酸（E错）、色氨酸（记忆技巧：芳香老本色）。